低钾血症的临床表现为
A. 腹胀、恶心、呕吐
B. 肠麻痹
C. 心律不齐
D. 心电图见T波改变
E. 以上均是

正确答案：E。以上均是

解析：本题考查低钾血症的临床表现。低钾血症的临床表现可有厌食、腹胀、恶心、呕吐（A对）、肠蠕动消失等肠麻痹（B对）表现；心脏受累主要表现为心律不齐（C对）。典型的心电图改变为早期出现T波降低、变平或倒置（T波改变）（D对），随后出现ST段降低、QT间期延长和U波。（ABCD均对，故E为本题的正确答案）。